药物致畸最敏感的时期是在妊娠
A. 12周内
B. 16周内
C. 24周内
D. 28周内
E. 32周内

正确答案：A。12周内

解析：妊娠期妇女最好不用或少用药物，用药也应在医师指导下使用。许多药物能通过胎盘屏障进入胎儿体内，导致胎儿畸形。妊娠12周内是药物致畸最敏感的时期。掌握“妊娠期妇女口腔保健”知识点。